上颌骨骨折复位后固定时间至少约为
A. 1周
B. 2周
C. 3周
D. 4周
E. 5周

正确答案：C。3周

解析：本题考查上颌骨骨折复位后固定的时间。上颌骨的血供丰富，既接受骨内上牙槽动脉的血供，又接受颊、唇、腭侧黏骨膜等软组织的血供，为成功的进行正颌外科截骨术以及颌骨骨折复位固定的愈合提供了重要基础。上颌骨骨折复位后固定时间至少约为3周（C对）。